健康女婴，4个月，母乳喂养。每天每公斤体重需要的热量是
A. 95kcal
B. 110kcal
C. 115kcal
D. 105kcal
E. 80kcal

正确答案：A。95kcal

解析：组织生长合成消耗能量即生长所需，为儿童特有，与儿童生长的速度成正比，随年龄增长逐渐减少。4个月女婴（＜6月），每天每公斤体重需要的热量是90kcal（A对），7-12月龄为80kcal（E错）。